患者常在劳累之后低热，伴有头晕乏力，气短懒言，食少纳呆，大便溏薄，舌淡苔白，脉弱。其治法是
A. 滋阴清热
B. 活血化瘀
C. 清肝泻热
D. 甘温除热
E. 益气养血

正确答案：D。甘温除热

解析：患者以低热为主诉，无外感表证的证候特点，故诊断为内伤发热；脾胃气虚，中气下陷，虚火内生，故发热；本有气虚，劳则耗气，故发热多在劳累后发生；脾胃虚衰，气血生化不足，脏腑经络无以充养，以致头晕乏力，气短懒言，舌淡苔白，脉弱；脾虚失于健运则食少纳呆，大便溏薄，故诊断为气虚发热证，治以益气健脾，甘温除热，代表方为补中益气汤（D对）。滋阴清热是阴虚发热证的治法（A错）。活血化瘀是血瘀发热证的治法(B错)。清肝泻热是气郁发热证的治法（C错）。.益气养血是血虚发热证的治法（E错）。